后腭杆的两端弯向前至
A. 第二双尖牙
B. 第二双尖牙与第一磨牙之间
C. 第一磨牙
D. 第一磨牙与第二磨牙之间
E. 第二磨牙

正确答案：D。第一磨牙与第二磨牙之间

解析：本题考查后腭杆。后腭杆两端微弯向第一、二磨牙之间，过后易引起恶心，对敏感者位置可适当向前调整（D对E错）。前腭杆大约位于双侧第一双尖牙之间的位置，前后腭杆的距离应大于等于15mm，所以也不能过于向前,若位于第二双尖牙（A错）、第二双尖牙与第一磨牙之间（B错）、第一磨牙（C错）会使前后腭杆之间的距离小于15mm,无法发挥其功能。